不参与I型超敏反应的介质或细胞因子是
A. 组胺
B. LT
C. PAF
D. PG
E. GM-CSF

正确答案：E。GM-CSF

解析：参与I型超敏反应的主要成人有变应原、IgE及其受体、前列腺素（PG），白三烯（LT）、血小板活化因子（PAF）等。掌握“概述及Ⅰ型超敏反应”知识点。